选项中的指标都可用来评价筛检试验方法可靠性的是
A. 灵敏度、特异度和阳性似然比
B. 相关系数、正确指数与似然比
C. 相关系数、变异系数和Kappa值
D. 预测值、约登指数和符合率
E. NNBS、似然比和Kappa值

正确答案：C。相关系数、变异系数和Kappa值

解析：本题考查可用来评价筛检试验方法可靠性的指标。可靠性是指在相同条件下用某测量工具（如筛检试验）重复测最同一受试者时结果的一致程度。相关系数、变异系数和Kappa值（C对ABDE错）都可用来评价筛检试验方法的可靠性。